通过抑制血管紧张素Ⅰ转换酶而发挥抗慢性心功能不全作用的代表药有
A. 地高辛
B. 卡托普利
C. 美托洛尔
D. 氯沙坦
E. 硝普钠

正确答案：B。卡托普利

解析：卡托普利（B对）属于血管紧张素转化酶抑制剂，减少血管紧张素Ⅱ的生成，舒张阻力血管，减轻心脏前、后负荷，改善心功能，临床可用于慢性心功能不全。地高辛（A错）属于强心苷类药物，通过作用于Na⁺-K⁺2-ATP酶，增强心肌收缩力，增大心输出量，用于慢性心功能不全。美托洛尔（C错）为选择性的β₁受体阻断药，主要作用于心脏β₁受体，减慢心率，减弱心肌收缩力，减少心输出量，降低收缩压，临床主要用于高血压和心绞痛的治疗。氯沙坦（D错）是第一个用于临床的血管紧张素Ⅱ受体阻断剂，与AT₁受体亲和力强，抑制血管紧张素Ⅱ与受体结合，产生血管扩张作用，降低血压，同时还有抑制心肌重构和血管重构等作用，临床用于各型高血压以及慢性心功能不全。硝普钠（E错）属于直接的扩血管药，能直接作用于小动脉，松弛血管平滑肌，降低外周阻力，降压作用强，临床用于高血压急症，慢性心功能不全，可用于对伴有心力衰竭的高血压患者。